治疗狂证痰热瘀结证，应首选
A. 顺气导痰汤
B. 越鞠丸
C. 生铁落饮
D. 琥珀养心丹
E. 癫狂梦醒汤

正确答案：E。癫狂梦醒汤

解析：癫狂狂证之痰热瘀结证病机是气郁痰结，血气凝滞，瘀热互结，神窍被塞。治宜豁痰化瘀，调畅气血，方选癫狂梦醒汤（E对）。癫狂癫证之痰气郁结证治宜理气解郁，化痰醒神，方选逍遥散合顺气导痰汤（A错）。癫狂癫证之心脾两虚证治宜健脾益气，养心安神，方选养心汤合越鞠丸（B错）。癫狂狂证之痰火扰神证治宜清心泻火，涤痰醒神，方选生铁落饮（C错）。癫狂狂证之火盛伤阴证治宜育阴潜阳，交通心肾，方选二阴煎合琥珀养心丹（D错）。